体现了新公共健康精神的项目是
A. 预防为主
B. 三级预防
C. 强化社区行动
D. 人人享有卫生保健
E. 群众性自我保健

正确答案：C。强化社区行动

解析：1986年第一届国际健康促进大会，确定了新公共健康的概念（即渥太华宪章）其主要精神为（预防医学第三版P4）：1.制定健康的公共政策：2.创造支持性环埦：3.强化社区行动（C对）：4.发展个人技能：5.调整卫生服务方向。这一宪章更具体地反映了人们对身心健康的综合需求及人们对健康的全面理解和追求。